镇肝熄风汤证的病机是
A. 肝经热盛，热极动风
B. 肝肾阴虚，阳亢动风
C. 肝阳偏亢，肝风上扰
D. 热灼真阴，虚风内动
E. 风邪外袭，上扰头目

正确答案：B。肝肾阴虚，阳亢动风

解析：镇肝熄风汤的功用为镇肝息风，滋阴潜阳，主治类中风。故镇肝熄风汤证的病机为肝肾阴虚，阳亢动风（B对）。羚角钩藤汤的功用为凉肝息风，增液舒筋，主治肝热生风证（A错）。天麻钩藤饮主治肝阳偏亢，肝风上扰证（C错）。大定风珠证的病机为热灼真阴，虚风内动（D错）。川芎茶调散的功用为疏风止痛，主治风邪外袭，上扰头目之头痛（E错）。